患者女性，40岁。反复发作晕厥伴呼吸困难，紫绀，晕厥发作似与体位变化有关。最可能的诊断为
A. 法洛四联症
B. 梗阻型原发性心肌病
C. 短暂性心律失常
D. 左房黏液瘤
E. 主动脉瓣狭窄

正确答案：D。左房黏液瘤

解析：中青年女性，反复发作晕厥伴呼吸困难，紫绀，其晕厥发作似与体位变化有关，最可能的诊断为左房黏液瘤，其导致房室瓣血流受阻出现气急、呼吸困难，当移动度较大的黏液瘤突然阻塞左房室瓣瓣孔，则导致突发晕厥，且与体位有关（D对）。法乐四联症是一种常见的先天性心脏畸形，其基本病理为室间隔缺损、肺动脉狭窄、主动脉骑跨和右心室肥厚，临床主要表现为发绀、呼吸困难和缺氧性发作及蹲踞（A错）。梗阻型原发性心肌病也称肥厚型原发性心肌病，临床主要症状为呼吸困难、心前区疼痛、乏力、头晕与昏厥，均多于劳累后出现，晚期有心力衰竭（B错）。短暂性心律失常常见临床表现为心悸心慌、胸闷、心脏停跳感，头晕，眼前发黑，其发作时间很短，与体位无关（C错）。主动脉瓣狭窄临床表现为呼吸困难、心绞痛和晕厥的典型主动脉瓣狭窄三联征，其晕厥多发生与直立、运动中或运动后即刻，此患者无心绞痛症状（E错）。